关于物理性质与毒性效应说法正确的是
A. 毒物脂/水分配系数越大，毒性越小
B. 毒物在体液中的溶解度越大，毒性越小
C. 非离子型比率越高，毒性越大
D. Ich越大，产生慢性中毒的危险性越小
E. 毒物分散度越小，毒性越大

正确答案：C。非离子型比率越高，毒性越大